根据药品飞行检查的有关规定，如果发现乙药品上市许可持有人以涉及商业秘密为由，拒绝检查员复印、拍摄有关销售数据记录，乙的行为属于
A. 拒绝配合检查员取证
B. 限制检查时间
C. 以故意停止经营的方式欺骗检查
D. 限制检查员进入被检查场所

正确答案：A。拒绝配合检查员取证

解析：本题考查飞行检查结果的处理。根据药品飞行检查的有关规定，如果发现乙药品上市许可持有人以涉及商业秘密为由拒绝检查员复印、拍摄有关销售记录，乙的行为属于拒绝配合检查员取证（A对）。药品监督管理部门有权在任何时间进入被检查单位研制、生产、经营、使用等场所进行检查，被检查单位不得拒绝、逃避。被检查单位有下列情形之一的，视为拒绝、逃避检查：①拖延、限制、拒绝检查人员进入被检查场所或者区域的（D错），或者限制检查时间（B错）的；②无正当理由不提供或者延迟提供与检查相关的文件、记录、票据、凭证、电子数据等材料的；③以声称工作人员不在、故意停止生产经营等方式欺骗（C错）、误导、逃避检查的；④拒绝或者限制拍摄、复印、抽样等取证工作的；⑤其他不配合检查的情形。